男性，19岁，无业青年，父亲是生意人，该青年5年来一直在购买收藏女性的高跟鞋而感到满足，而且晚上要抱着高跟鞋睡觉，在心理咨询门诊诊断为“恋物癖”，对此类患者的治疗方法最好选择
A. 人本主义
B. 厌恶疗法
C. 自由联想
D. 系统脱敏
E. 梦的分析

正确答案：B。厌恶疗法

解析：本题考查恋物癖的心理治疗方法。男性，19岁，无业青年，父亲是生意人，该青年5年来一直在购买收藏女性的高跟鞋而感到满足，而且晚上要抱着高跟鞋睡觉，在心理咨询门诊诊断为“恋物癖”，对此类患者的治疗方法最好选择厌恶疗法（B对）。人本主义（A错）是用于治疗有某种心理问题的正常人或轻度心理障碍患者，如人际关系问题，个人成长发展问题，社会适应不良、某些神经症的患者。系统脱敏（D错）主要用于治疗恐怖症，也可用于癔症。自由联想（C错）、梦的分析（E错）均属于精神分析疗法的技巧，可帮助发现病人压抑在潜意识中的冲突，是病人领悟到心理问题的潜意识症结，让焦虑的情绪得到宣泄，从而使其能以现实的方式处理和适应各种情况。